具有利水通淋退黄功效的药物是
A. 木通
B. 金钱草
C. 石韦
D. 地肤子
E. 海金沙

正确答案：B。金钱草

解析：金钱草药性甘、淡、咸、微寒，归肝、但、肾、膀胱经，其功效为利湿退黄，利尿通淋，解毒消肿（B对）。木通的功效为利尿通淋，清心除烦，通经下乳（A错）。石韦的功效为利尿通淋，清肺止咳，凉血止血（C错）。地肤子的功效为清热利湿，祛风止痒（D错）。海金沙的功效为清热利湿，通淋止痛（E错）。